乙型脑炎病毒的传播媒介是
A. 虱
B. 蚤
C. 蚊
D. 螨
E. 蜱

正确答案：C。蚊